烧伤达表皮层，按分度法属于
A. Ⅰ度
B. 浅Ⅱ度
C. 深Ⅱ度
D. Ⅲ度
E. 不在分度内

正确答案：A。Ⅰ度

解析：Ⅰ度（A对E错）烧伤仅伤及表皮浅层，生发层健在。浅Ⅱ度（B错）烧伤伤及表皮的生发层和真皮乳头层。深Ⅱ度（C错）烧伤伤及真皮乳头层以下。Ⅲ度（D错）烧伤伤及皮肤全层，可深达肌肉甚至骨骼、内脏器官等。